重度CO中毒时，HbCO血浓度至少应达到
A. 0.1
B. 0.4
C. 0.2
D. 0.3
E. 0.6

正确答案：B。0.4

解析：CO急性中毒按中毒程度可分为3级：轻度中毒血液COHb浓度为10%～20%（AB错）；中度中毒血液COHb浓度为30%～40%（C错）；重度中毒血液COHb血浓度为40%～60%（B对E错）。